主含环烯醚萜苷类成分的药材是
A. 补骨脂
B. 栀子
C. 连翘
D. 菟丝子
E. 决明子

正确答案：B。栀子

解析：本题考查栀子的主要化学成分。主含环烯醚萜苷类成分的药材是栀子（Ｂ对）。栀子【成分】含栀子苷、羟异栀苷、去羟栀子苷、山栀苷、栀子新苷等多种环烯醚萜苷类，以及绿原酸、栀子酸等有机酸类。补骨脂（Ａ错）【成分】含挥发油、香豆素、黄酮类、单萜酚、脂类化合物、树脂及豆甾醇等。连翘（Ｃ错）中的木脂素类成分多为双环氧木脂素及木脂内酯，《中国药典》以挥发油、连翘苷和连翘酯苷A为指标成分对连翘进行含量测定。菟丝子（Ｄ错）【成分】种子含胆甾醇、菜油甾醇、β-谷甾醇等另含槲皮素、紫云英苷、金丝桃苷、菟丝子苷等黄酮类化合物以及香豆精、氨基酸、树脂苷、糖类等成分。大决明和小决明（Ｅ错）的种子均含蒽醌类、萘并吡咯酮类、脂肪酸类化学成分等。